下列可作为片剂的润湿剂的是
A. 聚乙烯吡咯烷酮溶液
B. L-羟丙基纤维素
C. 乳糖
D. 乙醇
E. 聚乙二醇6000

正确答案：D。乙醇

解析：本题考查片剂的常用辅料。润湿剂系指本身没有黏性，而通过润湿物料诱发物料黏性的液体，常用的润湿剂有蒸馏水和乙醇（D对），其中蒸馏水是首选的润湿剂。聚乙烯吡咯烷酮溶液（A错）常用作片剂的黏合剂。低取代羟丙基纤维素（L-HPC）（B错）是片剂中常用的崩解剂。乳糖（C错）是片剂中常用的稀释剂。聚乙二醇6000（E错）常作为润滑剂、分散剂、赋形剂等。